适宜餐中服用的是
A. 泼尼松龙
B. 奥利司他
C. 氟伐他汀
D. 多潘立酮
E. 吲哚美辛

正确答案：B。奥利司他

解析：本题考查药品服用的适宜时间。奥利司他（B对）是减肥药，进餐时服用，可减少脂肪的吸收率。泼尼松龙（A错）是糖皮质激素类药物，宜清晨服用。氟伐他汀（C错）适宜于睡前服用。多潘立酮（D错）是促胃动力药，餐前服用帮助消化。吲哚美辛（E错）适宜在餐后服用。